药师不得调剂的处方有
A. 不规范的处方
B. 不能判定其合法性的处方
C. 没有医师签名的处方
D. 用药严重不合理的处方
E. 医师为自己开具的麻醉药品处方

正确答案：A、B、C、D、E。不规范的处方；不能判定其合法性的处方；没有医师签名的处方；用药严重不合理的处方；医师为自己开具的麻醉药品处方

解析：本题考查的是处方的调剂。药师不得调剂的处方有不规范的处方（A对）、不能判定其合法性的处方（B对）、没有医师签名的处方（C对）、用药严重不合理的处方（D对）、医师为自己开具的麻醉药品处方（E对）。处方内容：按照卫生部统一规定的处方标准，处方由前记、正文和后记三部分组成。（1）前记：包括医疗机构名称、患者姓名、性别、年龄、门诊或住院病历号，科别或病区和床位号、临床诊断、开具日期等，可添列特殊要求的项目。麻醉药品和第一类精神药品处方还应当包括患者身份证明编号，代办人姓名、身份证明编号。（2）正文：以Rp或R（拉丁文Recipe“请取”的缩写）标示，分列药品名称、剂型、规格、数量、用法用量。此部分是处方的核心内容，直接关系到患者用药的安全有效。（3）后记：医师签名或者加盖专用签章，药品金额以及审核、调配，核对、发药药师签名或者加盖专用签章。“四查十对”原则：药师调剂处方时必须做到“四查十对”：查处方，对科别、姓名、年龄；查药品，对药名、剂型、规格、数量；查配伍禁忌，对药品性状、用法用量；查用药合理性，对临床诊断。《处方管理办法》第三章处方权的获得第十一条：医疗机构应当按照有关规定，对本机构执业医师和药师进行麻醉药品和精神药品使用知识和规范化管理的培训。执业医师经考核合格后取得麻醉药品和第一类精神药品的处方权，药师经考核合格后取得麻醉药品和第一类精神药品调剂资格。医师取得麻醉药品和第一类精神药品处方权后，方可在本机构开具麻醉药品和第一类精神药品处方，但不得为自己开具该类药品处方。药师取得麻醉药品和第一类精神药品调剂资格后，方可在本机构调剂麻醉药品和第一类精神药品。第五章处方的调剂第四十条：药师对于不规范处方或者不能判定其合法性的处方，不得调剂。